人脑对直接作用于感觉器官的客观事物的个别属性的反映属于
A. 感觉
B. 知觉
C. 识记
D. 遗忘
E. 思维

正确答案：A。感觉

解析：感觉是人脑对直接作用于感觉器官的客观事物的个别属性的反映。掌握“认识过程”知识点。